目前人类健康需求的增加主要是因为
A. 人们健康观念的转变
B. 慢性非传染性疾病增加
C. 人们健康状况的下降
D. 老年性疾病的增加
E. 新型传染病的发病率增加

正确答案：A。人们健康观念的转变